可用于治疗心衰的药物是
A. 血管紧张素转换酶抑制剂
B. β受体阻断剂
C. 醛固酮受体阻断剂
D. 利尿剂
E. 强心苷

正确答案：A、B、C、D、E。血管紧张素转换酶抑制剂；β受体阻断剂；醛固酮受体阻断剂；利尿剂；强心苷

解析：本题考查治疗心衰的药物。目前推荐使用的治疗心衰的主要药物有：血管紧张素转换酶抑制剂（ACEI）（A对）：治疗心力衰竭。β受体阻断剂（B对）：抑制心肌重构，降低心脏猝死率。醛固酮受体阻断剂（C对）：阻断肾素-血管紧张素-醛固酮系统的通路，治疗重度心力衰竭。血管紧张素Ⅱ受体阻断剂（ARB）。利尿剂（D对）：控制心力衰竭患者的液体潴留。强心苷类（E对）：减轻症状和改善心功能。